接触粉尘1～2年发生的硅沉着病，属哪种硅沉着病
A. 硅沉着病
B. 晚发型硅沉着病
C. 硅酸盐肺
D. 肺尘埃沉着病
E. 速发型硅沉着病

正确答案：E。速发型硅沉着病